反映儿童近期营养状况及其影响的适宜指标是
A. 身高
B. 体重
C. 年龄别身高
D. 年龄别体重
E. 身高别体重

正确答案：E。身高别体重

解析：本题考查反映儿童近期营养状况及其影响的适宜指标。反映儿童近期营养状况及其影响的适宜指标是身高别体重（E对ABCD错）。